以下有关上颌神经的描述不正确的是
A. 为混合神经
B. 起自三叉神经节前缘的中部
C. 经圆孔达翼腭窝上部
D. 由眶下裂入眶更名眶下神经
E. 向前行于眶下沟、眶下管

正确答案：A。为混合神经

解析：上颌神经为感觉神经，起自三叉神经节前缘的中部，经圆孔达翼腭窝上部，由眶下裂入眶更名为眶下神经，向前行于眶下沟、眶下管，出眶下孔达面部。掌握“三叉神经的分支与分布”知识点。